下列结构不在左肾前面的是
A. 胃
B. 胰
C. 空肠
D. 结肠左曲
E. 十二指肠

正确答案：E。十二指肠

解析：胃（A对），胰（B对），空肠（C对），结肠左曲（D对）为左肾的毗邻器官。十二指肠（E错，为本题正确答案）为右肾的毗邻器官。